在体内可被儿茶酚O-甲基转移酶快速甲基化，使活性降低的药物是
A. 沙丁胺醇
B. 肾上腺素
C. 非尔氨酯
D. 吲哚美辛
E. 醋磺己脲

正确答案：B。肾上腺素

解析：本题考查肾上腺素。在体内可被儿茶酚O-甲基转移酶快速甲基化，使活性降低的药物是肾上腺素（B对）。参与甲基化反应的基团有酚羟基、胺基、巯基等。酚羟基的甲基化反应主要对象是具儿茶酚胺结构的活性物质，如肾上腺素，肾上腺素经儿茶酚-O-甲基转移酶（COMT）快速甲基化后生成3-O-甲基肾上腺素，活性降低。如支气管扩张药沙丁胺醇（A错）发生与硫酸的结合反应。钠通道阻滞药非尔氨酯（C错）首先在体内被酯酶水解并被醛脱氢酶催化下生成醛基氨甲酸酯，在发生分子内环合生成环唑啉酮，环唑啉酮脱氢生成强亲电性的2-苯基丙烯醛，易与蛋白的亲核基团发生迈克尔加成，产生特质性毒性。吲哚美辛（D错）在体内约有50%经O-脱甲基代谢，生成无活性的化合物。口服降糖药醋磺己脲（E错）发生脂环的氧化反应，主要代谢产物是反式4-羟基醋磺己脲。